女，28岁。停经43天，阴道少量流血2天，突感下腹部剧痛，伴肛门坠胀，恶心呕吐。查体：面色苍白，BP80/40mmHg，后穹隆穿刺抽出不凝血5ml，诊为异位妊娠，出血性休克。最佳处理是
A. 静脉输液、输血
B. 纠正休克同时手术
C. 待血压正常手术
D. 自体输血
E. 保守治疗

正确答案：B。纠正休克同时手术

解析：异位妊娠出血性休克，最佳处理是纠正休克同时手术（B对ACE错），应在输液、输血的同时迅速打开腹腔，钳夹输卵管出血部位，暂时控制出血，待血压上升后继续手术切除患侧输卵管。自体输血（八版外科学P27）（D错）适用于异位妊娠破裂大出血，是将收集到的腹腔积血，经抗凝、过滤回输给病人，既节约了库血，又减轻输血反应，但是应在自体输血抗休克的同时手术。